确定患者重型颅脑损伤深昏迷最有价值的体征是
A. 肠鸣音消失
B. 三凹征阳性
C. 深浅反射消失
D. 眼球固定
E. 呼之不应

正确答案：C。深浅反射消失

解析：深度昏迷时，全身肌肉松弛，对各种刺激均无反应，深浅反射均消失（C对）。肠鸣音消失（A错）见于急性腹膜炎或麻痹性肠梗阻等（P192）。三凹征阳性（B错）见于吸气性呼吸困难，如上呼吸道阻塞、支气管异物等（P22）。眼球固定（D错）见于中度昏迷（P61）。呼之不应（E错）见于轻度昏迷（P61）。